分泌促胃液素的主要部位是
A. 胃体
B. 胃窦和十二指肠
C. 十二指肠
D. 空肠
E. 回肠

正确答案：B。胃窦和十二指肠